最主要的排泄器官是
A. 肾脏
B. 胆汁
C. 肺脏
D. 胃肠液
E. 汗腺

正确答案：A。肾脏

解析：药物及其代谢产物通过排泄器官被排出体外的过程称为排泄，是药物最后彻底消除的过程，其中肾脏（A对）是最主要的排泄器官，非挥发性药物主要由肾脏随尿排出。某些药物经肝脏转化为极性较强的水溶性代谢产物，也可自胆汁排泄，通常分子量大于500Da的化合物可从人体胆汁排出，超过500Da的大分子化合物较难从胆汁排（B错）。气体以及挥发性药物主要从肺随呼气排出（C错）。药物也可经肠道排泄，经肠道排泄的药物主要有未被吸收的口服药物，随胆汁排泄到肠道的药物，由肠黏膜主动分泌到肠道的药物（D错）。许多药物还可以通过唾液、乳汁、汗液（E错）、泪液等进行排泄。